女，35岁。某大学教师。3个月前因出国问题与领导争吵，而后逐渐表现出情绪低落，兴趣减退，对未来悲观失望，认为领导和同事都疏远她，常有怨天尤人的表现。能主动求医，接触良好。初次接触首选的手段是
A. 宣泄
B. 领悟
C. 强化控制
D. 增强自信心
E. 以上都不是

正确答案：A。宣泄

解析：本例患者的在治疗初期，需要医生发现病人压抑在潜意识中的冲突，使病人领悟到心理问题的潜意识症结，让焦虑的情绪得到宣泄（A对），从而使其能以现实的方式处理和适应各种情况。